脂类的消化和吸收主要部位在
A. 十二指肠
B. 胃
C. 小肠
D. 结肠
E. 回肠

正确答案：C。小肠